35岁，曾生育2女孩，近半年来月经不调，8～20/26天，基础体温双相，月经第6天刮出子宫内膜病理为：仍可见分泌期内膜上述病例，该病人的下步治疗应为
A. 月经前半期给雌激素
B. 月经后第5天给克罗米酚
C. 下次月经前10～14日开始口服甲羟孕酮
D. 雌孕激素序贯
E. 雌孕激素联合

正确答案：C。下次月经前10～14日开始口服甲羟孕酮

解析：黄体萎缩不全的治疗：1）孕激素：使黄体及时萎缩，内膜完整脱落。自下次月经前10～14日幵始，每日口服甲羟孕酮10mg，连用10日，有生育要求者可肌内注射黄体酮。无生育要求者可口服单相避孕药。2）绒促性素：有促进黄体功能的作用，用法同黄体功能不足。（监测到卵泡成熟时应用hCG5000～10000U1次或分2次肌内注射。）掌握“功能失调性子宫出血”知识点。